男性，30岁，胃病患者，有上腹痛，无规律性，食欲减退，伴舌炎，舌萎缩和巨幼细胞贫血，应考虑哪种疾病
A. 胃溃疡
B. 胃癌
C. 萎缩性胃炎
D. 肥厚性胃炎
E. 急性胃黏膜病变

正确答案：C。萎缩性胃炎